下述哪块骨不属于跗骨
A. 楔骨
B. 骰骨
C. 跖骨
D. 距骨
E. 跟骨

正确答案：C。跖骨

解析：跗骨、跖骨和趾骨都属于足骨（C错，为本题正确答案）。跗骨包括距骨（D对）、跟骨（E对）、足舟骨、内侧楔骨（A对）、中间楔骨、外侧楔骨、骰骨（B对）。